患者，女，62岁。有冠心病心绞痛史1年。今日上午情绪激动后胸痛再次发作。查体：血压160/70mmHg，心率100次/分。心电图示窦性心动过速、房性早搏、ST段下降0.1mV。为迅速缓解症状应首先考虑的治疗是
A. 消心痛含服
B. 普鲁帕酮静注
C. 利多卡因静注
D. 硝酸甘油含服
E. 阿司匹林口服

正确答案：D。硝酸甘油含服

解析：冠心病心绞痛急性发作时，为迅速缓解症状应首先考虑的治疗药物是硝酸甘油（D对），可用0.3～0.6mg，置于舌下含化，迅速被唾液溶解而吸收，1～2分钟即开始起作用。消心痛含服（A错）为缓解期治疗用药。普鲁帕酮静注（B错）为广谱高效膜抑制性抗心律失常药。利多卡因静注（C错）为抗心律失常的用药。阿司匹林口服（E错）可以抗血小板凝聚，但均不是迅速缓解症状的首选治疗措施。